治疗带状疱疹可采用
A. 口服磺胺类药物
B. 注射干扰素或转移因子，口服镇痛药物
C. 注射链霉素每日0.5g，或异烟肼每日0.1g局部封闭，每日或隔日一次
D. 酮康唑：成人剂量为每日一次口服200mg，2~4周一个疗程
E. 口服各种维生素及微量元素

正确答案：B。注射干扰素或转移因子，口服镇痛药物

解析：本题考查带状疱疹的治疗。注射干扰素或转移因子，口服镇痛药物（B对）是治疗带状疱疹的有效方式。带状疱疹的治疗包括：抗病毒治疗，神经痛治疗，神经营养药物、免疫调节药物和糖皮质激素的应用，局部治疗和中医中药治疗。口服磺胺类药物（A错）多用于细菌感染后的抗菌治疗。注射链霉素每日0.5g，或异烟肼每日0.1g局部封闭，每日或隔日一次（C错）用于结核病的治疗。酮康唑：成人剂量为每日一次口服200mg，2～4周一个疗程（D错）用于真菌感染的治疗。口服各种维生素及微量元素（E错）用于体内维生素和微量元素缺乏的情况。